不提倡使用哌替啶的病症是
A. 手术后疼痛
B. 创伤性疼痛
C. 内脏绞痛
D. 分娩镇痛
E. 晚期癌症疼痛

正确答案：E。晚期癌症疼痛

解析：本题考查哌替啶。哌替啶在体内可转变为去甲哌替啶，有神经系统毒性，不适用于晚期癌性疼痛（E错，为本题正确答案）；哌替啶可用于各种剧痛，如创伤性疼痛（B对）、手术后疼痛（A对）、分娩镇痛（D对）等，也可与阿托品合用于内脏绞痛（C对）。